如果研究开始时研究人群病例已经产生，则不能进行
A. 队列研究
B. 前瞻性队列研究
C. 回顾性队列研究
D. 双向队列研究
E. 病例对照研究

正确答案：B。前瞻性队列研究